《希波克拉底誓言》中提出的医德根本原则是
A. 平等对待患者
B. 保守医密
C. 不伤害病人
D. 为病家谋利益
E. 不为妇人施堕胎手术

正确答案：D。为病家谋利益

解析：希波克拉底誓言…无论至于何处，遇男或女，贵人及奴婢，我之唯一目的，为病家谋幸福，并检点吾身，不作各种害人及恶劣行为，尤不作诱奸之事。凡我所见所闻，无论有无业务关系，我认为应守秘密者，我愿保守秘密。尚使我严守上述誓言时，请求神祗让我生命与医术能得无上光荣，我苟违誓，天地鬼神实共亟之（D对）。